有关AFP升高的临床意义，下列哪项正确
A. AFP＞200μg/L时可诊断肝细胞癌
B. 肝转移癌患者AFP常显著增高
C. 肝功异常伴有AFP增高常提示合并肝癌
D. 消化道其它肿瘤AFP不会升高
E. 肝细胞癌术后AFP又升高提示复发

正确答案：E。肝细胞癌术后AFP又升高提示复发

解析：AFP（甲胎蛋白）是诊断肝细胞癌特异性的标志物，现已广泛用于肝癌的普查、诊断、判断治疗效果及预测复发。生殖腺胚胎肿瘤和消化道其它肿瘤（如胃癌、胰腺癌等）AFP含量也可升高（D错）。当排除以上肿瘤时，AFP＞200μg/L，持续8周，结合影像学及肝功能变化作综合分析或动态观察，可诊断是否为肝细胞癌（A错）。肝细胞癌术后AFP又升高提示复发（E对）。原发性肝癌患者AFP常显著增高，肝转移癌（继发性肝癌）患者AFP检测一般为阴性（B错）。肝功能异常伴有AFP增高可分为两种情况：①AFP和ALT（丙氨酸氨基转移酶）平行或同步升高或ALT持续增高至正常的数倍，则肝炎的可能性大；②AFP持续升高，而ALT不升高，常提示合并肝癌（C错）。